可能使驾驶员出现眩晕或幻觉的药物是
A. 镇咳药右美沙芬
B. 抗病毒药金刚烷胺
C. 抗高血压药吲达帕胺
D. 解热镇痛药双氯芬酸
E. 周围血管扩张药氟桂利嗪

正确答案：A、B、D、E。镇咳药右美沙芬；抗病毒药金刚烷胺；解热镇痛药双氯芬酸；周围血管扩张药氟桂利嗪

解析：本题考查特殊人群用药。可能使驾驶员出现眩晕或幻觉的药物是镇咳药右美沙芬（A对）、抗病毒药金刚烷胺（B对）、解热镇痛药双氯芬酸（D对）、周围血管扩张药氟桂利嗪（E对）。右美沙芬会引起驾驶员嗜睡、眩晕。金刚烷胺服用后会有幻觉、精神错乱、眩晕、嗜睡、视力模糊。双氯芬酸服后可出现腹痛、呕吐、眩晕的症状。氟桂利嗪服用后使人有抑郁感、嗜睡、四肢无力、倦怠或眩晕。吲达帕胺（C错）是利尿药，对驾驶员正常驾驶无影响。